结核病的主要传染源是
A. 痰涂片阴性的肺结核患者
B. 痰涂片阳性的肺结核患者
C. 潜伏感染患者
D. 各类结核患者
E. 临床治愈的结核患者

正确答案：B。痰涂片阳性的肺结核患者

解析：本题考查结核病的主要传染源。结核病的主要传染源是痰涂片阳性的肺结核患者（B对ACDE错）。涂片检查是一个既可定性、又可定量的检查方法，每毫升痰内含10万个结核菌，则在10个视野内可找到1条结核菌。根据痰涂片观察的视野数和发现的抗酸杆菌条数，结核病诊断可以分为痰涂片阴性，可疑和阳性（＋～＋＋＋＋）。